下列关于咀嚼效率的叙述中，恰当的是
A. 前牙缺失对咀嚼效率的影响小于后牙缺失
B. 牙的功能性接触面积接触面积越大，咀嚼效率越高
C. 牙周组织耐受力下降，可使咀嚼效率降低
D. 过度疲劳、精神紧张等，可影响咀嚼效率
E. 以上均正确

正确答案：E。以上均正确

解析：影响咀嚼效率的因素①缺牙的位置：前牙缺失对咀嚼效率的影响小于后牙缺失。当不对称分布时，（牙合）单位数小于6时，则出现咀嚼效率低。②牙的功能性接触面积：在咀嚼系统功能正常的情况下，上下颌牙齿的功能性接触面积可以代表牙齿分裂或咀嚼食物的潜在能力，接触面积越大，咀嚼效率越高。③牙周组织：任何疾病或原因使牙周组织受损，导致牙周组织耐受力下降，从而使咀嚼效率降低。④颞下颌关节疾病：由于影响咀嚼运动，导致咀嚼功能不能充分发挥，使咀嚼效率降低。⑤口腔内软组织缺损、炎症、外伤后遗症可影响咀嚼效率。⑥全身的健康状态：全身性疾病或老年体弱者，可引起肌肉的退行性改变，从而影响咀嚼效率。⑦其他因素：过度疲劳、精神紧张和不良咀嚼习惯等，也可影响咀嚼效率。掌握“咀嚼过程、类型，咀嚼周期及生物力”知识点。